肺癌患者出现声音嘶哑提示
A. 肿瘤侵犯上腔静脉
B. 肿瘤侵犯喉返神经
C. 肿瘤侵犯颈交感神经节
D. 肿瘤侵犯膈神经
E. 肿瘤侵犯隆突

正确答案：B。肿瘤侵犯喉返神经

解析：局部晚期肺癌压迫或侵犯邻近器官时可产生下列症状和体征：①压迫或侵犯膈神经，引起同侧膈肌麻痹（D错）。②压迫或侵犯喉返神经，引起声带麻痹，声音嘶哑（B对）。③压迫上腔静脉，引起上腔静脉梗阻综合征，表现为面部、颈部、上肢和上胸部静脉怒张，皮下组织水肿（A错）。④肿瘤侵犯颈交感神经节，可引起同侧上眼睑下垂、瞳孔缩小、眼球内陷、面部无汗等颈交感神经综合征（Horner综合征）（C错）。⑤肿瘤侵犯隆突（气管隆脊，在胸骨角平面向外凸出，是支气管镜检查的重要标志），可引起气短、呼吸困难、喘鸣等症状（E错）。